原生环境是指
A. 受动物活动影响的天然环境
B. 未受人类活动影响的天然环境
C. 无动植物生存而仅有少量微生物存在的环境
D. 受人为活动影响的环境
E. 以人类为中心的环境

正确答案：B。未受人类活动影响的天然环境

解析：本题考查原生环境。原生环境是指天然形成的未受或少受人为因素影响的环境（B对ACDE错），其中存在大量对人体健康有益的因素，如清洁并含有正常化学成分，空气、水、土壤,充足的阳光和适宜的气候条件，秀丽的风光等都是对人体健康的有益因素